下列白细胞计数中，不正常的是
A. 成人静脉血4.3×10⁹/L
B. 成人末梢血8.0×10⁹/L
C. 成人静脉血3.0×10⁹/L
D. 新生儿16.0×10⁹/L
E. 6个月～2岁婴幼儿11.2×10⁹/L

正确答案：C。成人静脉血3.0×10⁹/L

解析：本题考查白细胞计数。下列白细胞计数中，不正常的是成人静脉血3.0×10⁹/L（C错，为本题正确答案）。白细胞计数正常参考范围：成人：（4.0～10.0）×10⁹/L（AB对C错）；新生儿：（15.0～20.0）×10⁹/L（D对）；6个月至2岁婴幼儿：（11.0～12.0）×10⁹/L（E对）。